肺病取中府、肺俞，其配穴方法是
A. 前后配穴
B. 表里配穴
C. 左右配穴
D. 上下配穴
E. 本经配穴

正确答案：A。前后配穴

解析：前后配穴法是指将人体前部和后部的腧穴配合应用的方法。中府在前胸，肺俞在后背。肺病取中府、肺俞，其配穴方法为前后配穴法（A对）。表里经配穴法（B错）是以脏腑、经脉的阴阳表里配合关系为依据的配穴方法；左右配穴法（C错）是指将人体左侧和右侧的的穴配合应用的方法；上下配穴法（D错）是指将腰部以上或上肢腧穴和腰部以下或下肢腧穴配合应用的方法；本经配穴法（E错）是当某一脏腑、经脉发生病变时，即选该脏腑、经脉的腧穴配成处方的配穴方法。